下列口腔条件中可采用固定修复的是
A. 牙列远中游离端缺失
B. 牙缺失数目多、缺隙跨度大
C. 前牙区伴有严重的颌骨缺损
D. 前牙缺失两侧基牙稳固
E. 以上条件均适合固定修复

正确答案：D。前牙缺失两侧基牙稳固

解析：本题考查固定局部义齿的适应证。固定桥修复由于其自身特点的限制，对适应症的要求比较严格。若前牙缺失且两侧基牙稳固（D对）可做固定修复。对缺牙部位来说，要求基牙好，缺牙少，但特殊部位应特殊对待，如牙列远中游离端缺失（A错），当上下颌游离端均缺失时可考虑不做修复，当单颌游离端缺失要求做单端固定桥修复时，那么桥体受力则会对基牙产生杠杆作用而引起基牙的损伤，故一般不采用固定修复。对缺牙数目来说，要求牙弓的少数牙缺失且间隔要小、缺隙跨度要小（B错），缺牙间隙越大、桥体跨度越大则要求固位体的固位力越大，临床上难以实现。对牙周组织来说，要求牙周组织健康，牙槽骨无吸收或少量吸收，若前牙区伴有严重的颌骨缺损（C错），那么基牙由于缺少牙槽骨的支持而不能承受较大（牙合）力，采用固定修复时很容易导致基牙损伤，故不适宜做固定桥修复。